交界性或临界性肿瘤是指
A. 良性肿瘤位于两个脏器交界处
B. 良性肿瘤来源于两种组织者
C. 形态属良性，但浸润性生长
D. 良性肿瘤位于重要器官
E. 有内分泌功能的良性肿瘤

正确答案：C。形态属良性，但浸润性生长

解析：交界性或临界性肿瘤是指组织形态和生物学行为介于良、恶性肿瘤之间的肿瘤，可见形态属良性，但有恶性肿瘤的表现，如呈浸润性生长（C对）。有内分泌功能的良性肿瘤（E错）有垂体瘤、肺良性神经内分泌瘤等。